治疗佝偻病活动早期给予维生素D口服法给药时间
A. 1月后改预防量
B. 2月后改预防量
C. 3月后改预防量
D. 4月后改预防量
E. 5月后改预防量

正确答案：A。1月后改预防量

解析：补充维生素D制剂口服法：每日给维生素D0.2万～0.4万IU，或1，25-（0H）2D3（罗盖全）0.5～2.0μg，连服2～4周后改为预防量，恢复期可用预防量维持。掌握“维生素D缺乏性佝偻病”知识点。